治疗蛔厥证，应首选的方剂是
A. 使君子散
B. 驱蛔承气汤
C. 乌梅丸
D. 驱绦汤
E. 驱虫粉

正确答案：C。乌梅丸

解析：蛔虫病是感染蛔虫卵引起的小儿常见肠道寄生虫病，以脐周疼痛、时作时止、饮食异常、大便下虫、或粪便镜检有蛔虫卵为主要特征。对于蛔厥证，当治以安蛔定痛，继而驱虫，乌梅丸能温脏安蛔，治疗肠寒胃热，蛔虫上扰所致蛔厥证，当选乌梅丸加减（C对）。